肺癌最常见的转移部位是
A. 脾
B. 脑
C. 肠
D. 胃
E. 肾

正确答案：B。脑

解析：肺癌经血道转移至全身各器官，最常转移至脑（B对）、肾上腺、骨。其次为肝、肾（E错）、甲状腺等。脾（A错）、肠（C错）、胃（D错）不是肿瘤的常见转移部位。